为注射剂溶剂的是
A. 山梨酸
B. 羟丙基甲基纤维素
C. 甲基纤维素
D. 微粉硅胶
E. 聚乙二醇400

正确答案：E。聚乙二醇400

解析：本题考查注射剂溶剂。注射用溶剂主要有注射用水、注射用油、乙醇、甘油、1,2-丙二醇、聚乙二醇300（PEG300）、聚乙二醇400（PEG400）（E对）、二甲基乙酰胺、苯甲酸苄酯、二甲基亚砜、油酸乙酯和肉豆蔻酸异丙酯等。山梨酸（A错）为液体制剂常用的防腐剂。羟丙基甲基纤维素（B错）为片剂薄膜包衣中的胃溶型包衣材料。甲基纤维素（C错）为水溶性软膏的基质组成成分，常与甘油明胶、CMC-Na共同使用。微粉硅胶（D错）为片剂常用的润滑剂。